卫生计生行政部门可以责令发生医疗事故的医务人员暂停执业活动的期限是
A. 1个月以上3个月以下
B. 6个月以上1年以下
C. 1年以上3年以下
D. 3个月以上6个月以下
E. 1年以上18个月以下

正确答案：B。6个月以上1年以下

解析：《医疗事故处理条例》规定，卫生计生行政部门可以责令发生医疗事故的医务人员暂停执业活动的期限是6个月以上1年以下（B对）。